下列哪种物质不能作混悬剂的助悬剂
A. 西黄蓍胶
B. 海藻酸钠
C. 硬脂酸钠
D. 羧甲基纤维素钠
E. 硅皂土

正确答案：C。硬脂酸钠

解析：本题考查混悬剂。硬脂酸钠（C错，为本题正确答案）不用作混悬剂的助悬剂。助悬剂系指能增加分散介质的黏度以降低微粒的沉降速度或增加微粒亲水性的附加剂。常用的助悬剂有：（1）低分子助悬剂。如甘油、糖浆剂等，在外用混悬剂中常加入甘油。（2）高分子助悬剂。①天然的高分子助悬剂，如阿拉伯胶、西黄蓍胶（A对）、桃胶、海藻酸钠（B对）、琼脂、淀粉浆等；②合成或半合成高分子助悬剂，如甲基纤维素、羧甲纤维素钠（D对）、羟丙纤维素、卡波姆、聚维酮、葡聚糖等。③硅皂土（E对）。④触变胶。